治疗肾阳不足，肠燥津枯便秘的药物是
A. 巴戟天
B. 肉苁蓉
C. 仙茅
D. 淫羊藿
E. 胡芦巴

正确答案：B。肉苁蓉

解析：肉苁蓉药性甘、咸、温，归肾、大肠经，其功效为补肾阳，益精血，润肠通便。可用于治疗肾阳不足，精血亏虚，阳痿不孕，腰膝酸软，筋骨无力；肠燥便秘（B对）。巴戟天的功效为补肾阳，强筋骨，祛风湿。治疗肾阳不足，阳痿遗精，宫冷不孕，月经不调，少腹冷痛；风湿痹痛，筋骨痿软（A错）。仙茅的功效为补肾阳，强筋骨，祛寒湿。治疗肾阳不足，命门火衰，阳痿精冷，小便频数；腰膝冷痛，筋骨痿软无力；阳虚冷泻（C错）。淫羊藿的功效为补肾壮阳，强筋骨，祛风湿。治疗肾阳虚衰，阳痿遗精，筋骨痿软；风寒湿痹，麻木拘挛（D错）。胡芦巴的功效为温肾助阳，祛寒止痛。治疗肾阳不足，下焦虚冷，阳痿滑泄，精冷囊湿；小腹冷痛，寒疝腹痛；小腹冷痛，寒疝腹痛（E错）。